关于胫神经的说法中,有何错误
A. 为坐骨神经的分支
B. 沿小腿后肌群之间下降
C. 经外踝后方入足底
D. 分布小腿后肌群及其表面皮肤
E. 分布足底肌和皮肤

正确答案：C。经外踝后方入足底

解析：胫神经为坐骨神经本于的延续（A对），在股后区下份沿中线下行进入腘窝，其后与位于深面的腘血管相伴下行至小腿后区、比目鱼肌深面（B对），继而伴胫后血管行至内踝后方，最后在屈肌支持带深面的踝管内分为足底内侧神经和足底外侧神经两终支进入足底区（C错，为本题正确选项）。胫神经在腘窝和小腿后区尚发出许多分支：其中肌支分布于小腿后群诸肌。皮支主要为排肠内侧皮神经，该皮支伴小隐静脉下行，沿途分支分布于相应区域的皮肤（E对）。